蛋白质-能量营养不良的最主要病因是
A. 喂养不当
B. 久吐、久泻
C. 早产
D. 反复外感
E. 各种虫证

正确答案：A。喂养不当

解析：蛋白质—能量营养不良（属于中医的“疳证”范畴）的病因，主要是由于喂养不当，或其他疾病的影响，或先天禀赋不足所致：饮食不节、喂养不当是发生疳证最主要的原因（A对），小儿的正常的生长发育有赖于脾胃运化的水谷精微，饮食不节、喂养不当使得胃不受纳，脾失健运，发为乳食停滞，反复发生，日久形成疳证。久吐、久泻（B错）、反复外感（D错）、各种虫证（E错），均为疾病影响，都可导致脾胃功能失调，气血亏虚，津液耗伤，而形成疳证，但多数情况下家长会采取干预措施避免向疳证发展，为次要病因。早产（C错）属先天因素，家长会采取措施追赶同龄儿生长，亦为次要病因。